男，68岁。因胃溃疡出血行毕I式胃大部切除术。术后第6天，有肛门排气，开始进流质饮食，进食后腹胀并呕吐，呕吐物中含胆汁。腹部可见胃型，无蠕动波。X线平片示残胃内大量胃液潴留。产生此症状最可能的原因是
A. 近端空肠返流
B. 远端空肠返流
C. 残胃蠕动功能障碍
D. 吻合口水肿
E. 吻合口不全梗阻

正确答案：C。残胃蠕动功能障碍

解析：老年男性患者，因胃溃疡出血行胃大部切除术，术后第6天，进食流质饮食后腹胀、呕吐，腹部可见胃型，但无蠕动波，X线平片示残胃内大量胃液潴留（提示胃蠕动功能减弱），有肛门排气（提示肠道蠕动功能正常），产生此症状最可能的原因是残胃蠕动功能障碍（C对）。空肠反流（AB错）是毕Ⅱ式胃大部切除术后的常见并发症，主要表现为上腹或胸骨后烧灼痛、呕吐胆汁样液体，腹部不会出现胃型。吻合口水肿（D错）、吻合口不全梗阻（E错）可有呕吐，但呕吐物一般不含胆汁，且患者胃蠕动功能正常，腹部可见蠕动波。